婚前医学检查的主要疾病
A. 严重遗传性疾病、指定传染病、重性精神病和重要脏器疾病
B. 由遗传因素先天形成，患者全部或部分丧失自主生活能力，子代再现风险高，医学上认为不宜生育的遗传性疾病
C. 艾滋病、淋病、梅毒、麻风病以及医学上认为影响结婚和生育的其他传染病在传染期内
D. 指精神分裂症、躁狂抑郁型精神病以及其他重型精神病在发病期间
E. 重要脏器疾病伴有明显功能不全阶段，医学上认为结婚和生育可能导致母婴严重后果者

正确答案：A。严重遗传性疾病、指定传染病、重性精神病和重要脏器疾病

解析：本题考查婚前医学检查的主要疾病。婚前医学检查的重点是影响婚育的疾病，包括严重遗传性疾病、指定传染病、有关精神病、重要脏器疾病和生殖器异常（A对BCDE错）。